周期性麻痹的补钾盐方式应首选
A. 口服氯化钾
B. 静滴葡萄糖加氯化钾
C. 静滴氯化钠加氯化钾
D. 静滴氯化钾
E. 静滴林格氏液

正确答案：A。口服氯化钾

解析：周期性麻痹的补钾盐方式应首选口服氯化钾（A对）。静滴葡萄糖加氯化钾（B错）有助于葡萄糖和钾离子向细胞内转移，导致细胞外钾离子降低，会加重低血钾。静滴氯化钠加氯化钾（C错）和静滴氯化钾（D错）都会使血钾迅速升高，两者适用于血钾严重降低，急需快速提高血钾浓度的患者，需要严格监测，并不作为周期性麻痹的首选补钾盐方式。林格氏液（E错）的组份与普通的生理盐水相似，钾离子含量并不高，无法满足周期性麻痹的补钾需求量。